自觉地克服困难以实现预定目标的心理过程属于
A. 记忆过程
B. 认知过程
C. 意志过程
D. 情绪过程
E. 理论过程

正确答案：C。意志过程

解析：意志过程：在认识和改造世界的活动中，人不仅能认识事物并产生一定的情绪情感，而且还能有意识地自觉地确定行动目的，并根据目的调节支配自身的行为。自觉地克服困难以实现预定目标的心理过程叫意志过程。掌握“心理学概述”知识点。